子宫颈的下端平对
A. 坐骨棘水平
B. 坐骨棘平面稍上方
C. 耻骨联合下缘
D. 坐骨结节水平
E. 无

正确答案：B。坐骨棘平面稍上方

解析：坐骨棘平面稍上方（B对）为子宫颈的下端平对。